下颌局部义齿修复中，舌杆适用于
A. 口底浅，舌系带附着过高
B. 下前牙向舌侧倾斜
C. 下颌舌侧倒凹过大
D. 下前牙向唇侧倾斜，舌系带附着低
E. 下颌双侧全部后牙缺失，舌系带附着高

正确答案：D。下前牙向唇侧倾斜，舌系带附着低

解析：舌杆：位于下颌舌侧龈缘与舌系带或口底黏膜皱襞之间。舌杆纵剖面呈半梨形，边缘圆滑，上缘薄（1mm）而下缘厚（2mm），上缘离开牙龈缘至少3～4mm。舌杆适用于口底有一定深度，舌侧无明显倒凹者。禁忌证是口底浅，前牙向舌侧倾斜，或有明显舌隆突但外科手术不能去除者。掌握“局部义齿连接体”知识点。